显露面神经分支的标志中，其中颊支显露标志是
A. 可以腮腺管作为标志
B. 可以耳屏或颞浅动脉作为标志
C. 可以耳屏、耳垂及眼外眦作为标志
D. 可以面动脉、面静脉、下颌角及下颌后静脉为标志
E. 可以腮腺浅叶下端作为标志

正确答案：A。可以腮腺管作为标志

解析：本题考查腮腺咬肌区、腮腺与面神经解剖关系。颊支显露标志：可以腮腺管作为标志（A对）。颊支多位于腮腺管上下约1cm范围内的咬肌筋膜上。